二尖瓣狭窄患者出现急性左心衰竭时，一般不宜采用的治疗措施是
A. 面罩吸氧
B. 静脉注射呋塞米
C. 静脉注射毛花苷丙
D. 静脉滴注硝酸甘油
E. 无创通气

正确答案：C。静脉注射毛花苷丙

解析：二尖瓣狭窄患者出现急性左心衰竭时，会出现严重肺水肿，此时患者使用洋地黄类（如毛花苷丙）可因增加右心室收缩功能而加重肺水肿程度，因此禁用洋地黄类药物（C错，为本题正确答案）。面罩吸氧（A对）、无创通气（E对）为治疗急性左心衰竭的一般治疗，呋塞米（B对）除利尿作用外，还有静脉扩张作用，有利于肺水肿缓解。硝酸甘油（D对）可扩张小静脉，减少回心血量，减轻肺水肿。